善治肺热咳嗽痰多的药物是
A. 半夏
B. 天南星
C. 两者均是
D. 两者均不是

正确答案：D。两者均不是

解析：本题考查的是半夏与天南星的主治病证。半夏与天南星均不能治疗肺热咳嗽痰多（D对）。半夏（A错）：【主治病证】（1）痰多咳喘，痰饮眩悸，风痰眩晕，痰厥头痛。（2）胃气上逆，恶心呕吐。（3）胸脘痞闷，梅核气，瘿瘤痰核，痈疽肿毒。天南星（B错）：【主治病证】（1）顽痰咳嗽。（2）风痰眩晕，中风口眼㖞斜，癫痫，破伤风。（3）痈疽肿痛，瘰疬痰核。肺热咳嗽痰多为桑白皮的主治病证。桑白皮：【主治病证】（1）肺热之咳喘痰多。（2）浮肿尿少，小便不利。